治肠痈腹痛、多种瘀血证，可选用
A. 火麻仁
B. 甘遂
C. 大黄
D. 芒硝
E. 巴豆

正确答案：C。大黄

解析：本题考查的是大黄的主治病证。治肠痈腹痛、多种瘀血证，可选用大黄（C对）。大黄：【主治病证】（1）大便秘结，胃肠积滞，湿热泻痢初起。（2）火热上攻之目赤、咽喉肿痛、口舌生疮、牙龈肿痛。（3）热毒疮肿，水火烫伤。（4）血热之吐血、衄血、咯血、便血。（5）瘀血闭经，产后瘀阻腹痛，癥瘕积聚，跌打损伤。（6）湿热黄疸，淋证涩痛。火麻仁（A错）：【主治病证】老人、产妇及体虚之津枯肠燥便秘。甘遂（B错）：【主治病证】（1）身面浮肿，大腹水肿，胸胁停饮。（2）风痰癫痫。（3）痈肿疮毒。芒硝（D错）：【主治病证】（1）实热积滞，大便燥结。（2）咽喉肿痛，口舌生疮，目赤肿痛，疮疡，乳痈，肠痈，痔疮肿痛。巴豆（E错）：【主治病证】（1）寒积便秘，腹满胀痛，小儿痰食积滞。（2）大腹水肿。（3）寒实结胸，喉痹痰阻。（4）痈肿脓成未溃，恶疮烂肉，疥癣。